上颌Kennedy第一类牙列缺损者可以采取单侧分别设计的病例是
A. 两侧上颌78
B. 上颌右侧678、左侧45678
C. 上颌右侧24678、左侧3678
D. 上颌右侧78、左侧3678
E. 上颌右侧5678、左侧78

正确答案：A。两侧上颌78

解析：本题考查Kennedy第一类牙列缺损的义齿设计。上颌Kennedy第一类牙列缺损者可以采取单侧分别设计的病例是两侧上颌78（A对）。Kennedy第一类牙列缺损是指牙弓两侧后部牙缺失，远中无天然牙存在。修复时一般需用连接体将两侧义齿部件相连，若上颌双侧第二磨牙缺失，缺牙数目不多，患者不愿或不能接受跨牙弓连接体牙弓两侧的义齿也可以不用大连接体连接到一起，可单侧分别设计，各自独立修复缺牙。上颌右侧678、左侧45678（B错），上颌右侧24678、左侧3678（C错），上颌右侧78、左侧3678（D错），上颌右侧5678、左侧78（E错）缺牙过多，单侧分别设计，无法获得足够的固位、支持和稳定，对基牙损伤也较大，需将两侧的义齿用大连接体连在一起。